下列关于膀胱底的描述正确的是
A. 其内面有一个三角形平滑区域称膀胱三角
B. 朝向后下方
C. 在女子与子宫体相邻
D. 在男性与输精管壶腹和精囊腺相邻
E. 上述说法全部正确

正确答案：E。上述说法全部正确

解析：膀胱底朝向后下方（A对），内面三角形平滑区域称膀胱三角（B对），与男性精囊、输精管（C对）壶腹和直肠相毗邻，女性子宫和阴道相毗邻（D对，故E为本题正确答案）。